患者，女，30岁。干咳少痰1周，咽干音哑，口干喜饮，舌边尖红，苔薄黄，脉浮数应选
A. 杏仁、桃仁、薏苡仁
B. 荆芥、白前、陈皮
C. 杏仁、麻黄、石膏
D. 杏仁、川贝、桑叶
E. 杏仁、麦冬、生地

正确答案：D。杏仁、川贝、桑叶

解析：桑叶苦寒清泄肺热，甘寒凉润肺燥，故可用于肺热或燥热伤肺，咳嗽痰少，色黄而质稠，或干咳少痰，咽痒等症。轻者可配苦杏仁、沙参、贝母等同用，如桑杏汤（D对）。杏仁的功效为降气止咳平喘，治疗咳嗽气喘，胸满痰多。桃仁的功效为止咳平喘，治疗咳嗽气喘。薏苡仁的功效为利水渗湿，健脾止泻，除痹，排脓，解毒散结（A错）。荆芥的功效为解表散风，透疹，消疮（B错）。白前的功效为降气，祛痰，止咳。治疗肺气壅实，咳嗽痰多，胸满喘急。陈皮的功效为理气健脾，燥湿化痰。治疗湿痰寒痰，咳嗽痰多。麻黄的功效为宣肺平喘，治疗胸闷喘咳。石膏的功效为生用：清热泻火，除烦止渴；煅用：收湿，生肌，敛疮，止血（C错）。麦冬的功效为养阴润肺，治疗肺燥干咳，阴虚劳嗽，喉痹咽痛。生地的功效为清热凉血，养阴生津（E错）。